根据建（牙合）的前后向动力平衡，如果牙齿缺失，位于缺牙远中的邻牙因近中支持丧失，在向前的推动力作用下将
A. 向近中移动或倾斜
B. 向远中移动或倾斜
C. 向唇侧移动或倾斜
D. 向舌侧移动或倾斜
E. 以上均正确

正确答案：A。向近中移动或倾斜

解析：向后的力主要加在上、下颌前牙，通过邻面接触点而传至整个牙弓，又通过牙尖斜面在上、下牙之间相互传递。如果牙齿缺失，位于缺牙远中的邻牙因近中支持丧失，在向前的推动力作用下将向近中移动或倾斜，而位于缺牙近中的邻牙也会因缺少远中支持，在（牙合）力的作用下向远中移动或倾斜。掌握“（牙合）的生长发育”知识点。